以下符合生态学研究的特点是
A. 机体内暴露水平上研究暴露与疾病之间的关系
B. 群体水平上研究暴露与疾病之间的关系
C. 个体水平上研究暴露与疾病之间的关系
D. 分子水平上研究暴露与疾病之间的关系
E. 开展专题流行病学调查研究暴露与疾病之间的关系

正确答案：B。群体水平上研究暴露与疾病之间的关系

解析：本题考查生态学研究的特点。生态学研究是在群体的水平上研究某种因素与疾病之间的关系，以群体为观察和分析的单位，通过描述不同人群中某因素的暴露状况与疾病的频率，分析该暴露因素与疾病之间的关系（B对ACDE错）。